药物的副反应是
A. 药物本身固有的
B. 较严重的药物不良反应
C. 剂量过大时产生的不良反应
D. 药物作用选择性
E. 与药物治疗目的有关的效应

正确答案：A。药物本身固有的